口腔内缝线打结应打
A. 单重结
B. 二重结
C. 三重结
D. 四重结
E. 五重结

正确答案：C。三重结

解析：本题考查打结。三重结，又称为三叠结，是在方结的基础上再打一个单结，且第三个结与第二个结方向相反；适用于口腔内（C对），及结扎较大的动脉和张力较大的组织缝合，不易滑脱。单重结（A错）很少用于临床上。口腔内组织张力大，而二重结（B错）易滑脱，口内很少使用。三重结就能取得较好的效果，四重结（D错）与五重结（E错）太过繁琐，不适用于口腔内。